既能平肝潜阳、镇惊安神又能纳气定喘的药物是
A. 龙骨
B. 牡蛎
C. 朱砂
D. 磁石
E. 石菖蒲

正确答案：D。磁石

解析：磁石的功效是镇惊安神，平肝潜阳，聪耳明目，纳气平喘（D对）。龙骨（A错）的功效是镇惊安神，平肝潜阳，收敛固涩。牡蛎（B错）的功效是潜阳补阴，重镇安神，软坚散结，收敛固涩，制酸止痛。朱砂（C错）的功效是清心镇惊，安神明目，解毒。石菖蒲（E错）的功效是开窍豁痰，醒神益智，化湿开胃。